生殖器疱疹的主要传播方式是
A. 性传播
B. 血制品
C. 粪-口途径
D. 飞沫传播
E. 垂直传播

正确答案：A。性传播